可辅助鉴别诊断系统性红斑狼疮的实验室技术是
A. 外周血中抗核抗体的测定
B. 外周血白细胞的分类计数
C. 血清中IgE的含量测定
D. 血清中免疫球蛋总量测定
E. 外周血中自身抗原的测定

正确答案：A。外周血中抗核抗体的测定